男婴，11个月，发热4天，皮疹1天。体温波动在39～40℃，伴发热，咳嗽，声嘶。查体：颜面，躯干可见红色斑丘疹，结膜充血，口腔黏膜充血且粗糙，可见细小白点，双肺闻及少量干啰音。最有诊断价值的临床表现是
A. 结膜充血
B. Koplik斑
C. 眼鼻卡他样症状
D. 发热
E. 皮疹形态

正确答案：B。Koplik斑

解析：麻疹是由麻疹病毒引起的传染性呼吸道疾病。可表现呼吸道卡他炎症，发热第2～3天口腔麻疹黏膜斑；皮疹特点为红色斑丘疹，退疹后有色素沉着及细小脱屑；发热3～4天后出疹，出疹期为发热高峰。患儿高热、流涕，皮肤出现红色斑丘疹，出疹时体温升高，且出现白色的麻疹黏膜斑，即Koplik斑，为典型的麻疹（B对）。